念珠菌性口炎临床上可分为以下几型
A. 急性假膜型、急性红斑型、萎缩型
B. 慢性肥厚型、急性红斑型、溃疡型
C. 急性假膜型、急性红斑型、充血型
D. 急性假膜型、急性红斑型、坏死型
E. 假（伪）膜型、急性红斑型、慢性红斑型、慢性增殖性念珠菌病

正确答案：E。假（伪）膜型、急性红斑型、慢性红斑型、慢性增殖性念珠菌病

解析：有关念珠菌病的分型方法较多。国际上过去公认Lehner（1966）的经典分型，最新作了修改如下：①假（伪）膜型念珠菌病，可表现为急性或慢性；②急性红斑型（萎缩型）念珠菌病；③慢性红斑型（萎缩型）念珠菌病；④慢性增殖性念珠菌病。临床上相对常见的是前三型。掌握“口腔念珠菌病”知识点。